《中国药典》2010年版一部规定的水分测定法有
A. 烘干法
B. 甲苯法
C. 减压干燥法
D. 高效液相色谱法
E. 气相色谱法

正确答案：A、B、C、E。烘干法；甲苯法；减压干燥法；气相色谱法

解析：本题考查的是水分测定方法。《中国药典》2010年版一部规定的水分测定法有烘干法（A对）、甲苯法（B对）、减压干燥法（C对）与气相色谱法（E对）。《中国药典》规定水分测定法有五种：第一法（费休氏法）包括容量滴定法和库仑滴定法。第二法（烘干法）适用于不含和少含挥发性成分的药品，如三七、广枣等。第三法（减压干燥法）适用于含挥发性成分的贵重药品，如厚朴花、蜂胶等。第四法（甲苯法）适用于含挥发性成分的药品，如肉桂、肉豆蔻、砂仁等。第五法（气相色谱法），如辛夷。